关于横断面分析哪一项是不正确的
A. 说明同一时期不同年龄死亡率的变化
B. 说明不同年代各年龄组死亡率的变化
C. 说明不同年代出生者各年龄组的死亡趋势
D. 不能说明不同年代出生者各年龄组的死亡趋势
E. 不能正确显示致病因子与年龄的关系

正确答案：C。说明不同年代出生者各年龄组的死亡趋势